胫骨中段闭合性骨折发生骨筋膜室综合征，处理不当造成的严重后果为
A. 创伤性关节炎
B. 损伤性骨化
C. 缺血性骨坏死
D. 急性骨萎缩
E. 缺血性肌挛缩

正确答案：E。缺血性肌挛缩

解析：骨筋膜室综合征造成肌肉和神经急性缺血，恢复血液供应后大部分肌肉坏死，形成挛缩畸形（即缺血性肌挛缩）（E对）。